腹主动脉的脏支不包括
A. 肾上腺中动脉
B. 腹腔干
C. 肠系膜上动脉
D. 卵巢动脉
E. 膈下动脉

正确答案：E。膈下动脉

解析：肾上腺中动脉（A对）、腹腔干（B对）、肠系膜上动脉（C对）、卵巢动脉（D对）均为腹主动脉的脏支。膈下动脉（E错，为本题正确答案）为腹主动脉的壁支。